HLA复合体不编码
A. HLA-Ⅰ类分子的α链
B. HIA-Ⅰ类分子的β₂m链
C. HLA-Ⅱ类分子的α链
D. HLA-Ⅱ类分子的β链
E. B因子

正确答案：B。HIA-Ⅰ类分子的β₂m链